颈椎病患者，MRI检查见C₅-₆间盘突入椎管压迫脊髓，保守治疗无效，瘫痪逐渐加重，应选择哪种治疗方案
A. 前路人工椎间盘罝换术
B. 后路椎管扩大形成术
C. 后路椎板切除术
D. 前外侧椎管减压术
E. 前路髓核摘除植骨术

正确答案：A。前路人工椎间盘罝换术

解析：颈椎病主要指颈椎间盘退行性变及其继发性椎间关节退行性变所致脊髓、神经血管损害而表现的相应症状和体征，该患者MRI检查见椎间盘突入椎管压迫颈段脊髓，保守治疗已无效且症状逐渐加重，故该患者当前应选择手术治疗。前路及前外侧手术适用于切除突出之椎间盘、椎体后方骨赘及钩椎关节骨赘，后路适用于脊髓减压辅助脊柱融合术的治疗，本例患者致病原因为颈椎间盘突出，故应选择前路人工椎间盘置换术（A对BC错）。前路人工椎间盘置换术主要适用于一节段锥体；后路椎管扩大术主要用于连续多节段锥体，并可进行椎骨融合；后路椎板切除术目前少用；DE选项名称不规范。前外侧椎管减压术（D错）只能暂时减轻症状，对于疾病进展没有帮助。前路髓核摘除植骨术（E错）不能用于颈椎病患者，易导致关节僵硬影响病人活动。